牡丹皮不具有的功效是
A. 清热
B. 凉血
C. 散瘀血
D. 退虚热
E. 清肝火

正确答案：E。清肝火

解析：本题考查的是牡丹皮的功效。牡丹皮不具有的功效是清肝火（E错，为本题正确答案）。牡丹皮：【功效】清热（A对）凉血（B对），活血散瘀（C对），退虚热（D对）。清肝火为赤芍的功效。赤芍：【功效】清热凉血，散瘀止痛，清肝火。